治疗病毒性肺炎宜选用
A. 两性霉素B
B. 苯唑西林
C. 利巴韦林
D. 阿奇霉素
E. 阿莫西林/克拉维酸钾

正确答案：C。利巴韦林

解析：本题考查病毒性肺炎的用药。治疗病毒性肺炎宜选用利巴韦林（C对）。利巴韦林可用于呼吸道合胞病毒引起的病毒性肺炎与支气管炎。两性霉素B（A错）为抗真菌药。苯唑西林（B错）为β-内酰胺类抗生素。阿奇霉素（D错）为大环内酯类抗生素。阿莫西林/克拉维酸钾（E错）为复方制剂，阿莫西林为不耐酶的β-内酰胺类抗生素，克拉维酸钾属于β-内酰胺酶抑制剂，两者合用可治疗流感嗜血杆菌引起的肺炎。